一种成熟组织变成另一种成熟组织的过程称为
A. 机化
B. 钙化
C. 分化
D. 化生
E. 适应

正确答案：D。化生

解析：一种成熟组织变成另一种成熟组织的过程称为化生（D对）。机化（P21）（A错）是指组织和细胞损伤后，新生肉芽组织长入并取代坏死组织、血栓、异物等的过程。钙化（P22）（B错）是指坏死细胞和细胞碎片未被及时清除，日后吸引钙盐和其他矿物质沉积的过程。分化（C错）是指同一来源的细胞逐渐产生出形态结构、功能特征各不相同的细胞类群的过程。适应（P5）（E错）是指细胞和组织对于内、外环境中的持续性刺激和各种有害因子所产生的非损伤性应答反应。